患者，男，28岁，以前精神正常，到某地出差刚下火车，突然感到要爆发战争了，因为好多人都往出口处跑。最可能的诊断是
A. 幻觉
B. 感知综合障碍
C. 继发性妄想
D. 错觉
E. 原发性妄想

正确答案：E。原发性妄想

解析：本题考查原发性妄想。28岁男患，以前精神正常，到某地出差刚下火车，突然感到要爆发战争了，因为好多人都往出口处跑（患者想法是突然产生的，内容与当时处境和思路无法联系，十分明显而坚定不移的妄想体验，属于原发性妄想临床表现）。最可能的诊断是原发性妄想（E对）。